银汞合金充填刻形后磨光的目的在于
A. 增加充填物表面光洁度和耐腐蚀性能
B. 继续对银汞合金加压
C. 进一步减少合金与洞壁之间的缝隙，特别是边缘部
D. 以上都是

正确答案：A。增加充填物表面光洁度和耐腐蚀性能

解析：本题考查银汞合金充填刻形后磨光的目的。银汞合金充填刻形后磨光的目的去除充填体表面不平整的缺陷，增加充填物表面光洁度和耐腐蚀性能（A对），减少菌斑附着，从而减少继发龋发生。磨光是在充填后24小时后进行，此时银汞合金完全固化，继续对其加压不起作用（B错）。磨光可使充填体与洞缘之间更平滑、一致，但不能减少合金与洞壁之间的缝隙（C错），合金与洞壁之间的缝隙可通过充填时加压充填等方法来减小。